眼眶周围色黑，带下清稀量多，腰酸困重，多属
A. 肾虚水饮
B. 寒湿带下
C. 湿热下注
D. 脾虚湿盛
E. 肾阴亏虚

正确答案：B。寒湿带下

解析：目眶周围色黑，多因寒湿下注所致。寒湿下注，带脉不固，妇女可见带下清稀量多；湿性重着，湿邪困脾，遏郁清阳，则腰酸困重（B对）。肾虚水饮是浮肿以腰以下为甚、小便不利与肾阳虚症状共见（A错）。湿热下注大肠，肠道气机不畅，则便溏不爽；湿热下注膀胱，则小便短黄（C错）。脾虚湿盛表现为不欲食或纳少，腹胀，食后胀甚，便溏，神疲乏力，少气懒言，肢体倦怠，或浮肿，或消瘦，或肥胖，面色萎黄，舌淡苔白，脉缓或弱（D错）。肾阴亏虚是指肾阴亏损，失于滋养，虚热内扰，以腰酸而痛、遗精、经少、头晕耳鸣及阴虚症状为主要表现的证（E错）。